女，18岁，左膝内下硬性肿块2月，无痛。X片示：左胫骨干骺端内侧有正常骨组织的疣状肿物，界限清楚，无骨膜反应，诊断首先考虑
A. 骨软骨瘤
B. 骨巨细胞瘤
C. 骨肉瘤
D. 骨转移性癌
E. 骨囊肿

正确答案：A。骨软骨瘤

解析：青少年女性患者，左膝内下硬性肿块、无痛、与周围组织界限清楚（提示肿物为良性），X片示左胫骨干骺端内侧有正常骨组织的疣状肿物、无骨膜反应（骨软骨瘤典型影像学表现），结合患者临床表现和影像学检查，该患者诊断首先考虑左胫骨骨软骨瘤（A对）。骨巨细胞瘤（B错）X线片特征性表现为骨端偏心性、溶骨性、囊性破坏而无骨膜反应。骨肉瘤（C错）X线片表现为骨质破坏、骨膜反应明显，可见Codman三角或“日光射线”形态，肿瘤边界不清。骨转移性癌（D错）临床表现主要取决于原发肿瘤部位、性质和转移灶的部位。骨囊肿（E错）好发于长管骨干骺端，多无明显症状，X线片常表现为干骺端圆形或椭圆形界限清楚的溶骨性病灶。